人群健康策略强调的是
A. 重点人群的健康影响因素
B. 特定疾病的临床病因
C. 除患者外的人群的健康
D. 高危个体的危险因素
E. 关注全体人群的健康

正确答案：E。关注全体人群的健康

解析：人群健康策略强调的是全人群策略和高危人群策略兼顾，全人群策略是以公共卫生思维为导向的实现第一级预防的策略。它通过针对人群中有害暴露的决定因素采取措施，降低整个人群有害暴露水平，进而降低人群总的疾病负担（E对）。重点人群的健康影响因素和高危个体的危险因素在高危策略中被关注，但是高危策略当问题的根源波及整个人群时高危策略仅仅治疗患者和显著易感的个体，是治标不治本的策略（AD错）。特定疾病的临床病因是临床医生在面对患者时需要关注的问题（B错）。关注除患者外的人群的健康涵盖了第一级预防和第二级预防，但是人群健康策略需要关注的是全体人群的健康，应该也应包含患者在内（C错）。